胃粘膜上皮异常增生的病理改变
A. 胃粘膜上皮和腺体被杯状细胞和幽门腺细胞取代
B. 上皮细胞增生和分化缺失
C. 淋巴细胞，浆细胞等慢性炎症改变
D. 腺体缺失，间质纤维化
E. 中性粒细胞浸润

正确答案：B。上皮细胞增生和分化缺失

解析：慢性胃炎组织学变化主要包括炎症、萎缩、化生、异型增生，其中胃粘膜上皮和腺体被杯状细胞和幽门腺细胞取代属于化生现象（A错）；上皮细胞增生和分化缺失属于胃粘膜上皮异型增生的病理表现（B对）；淋巴细胞，浆细胞等慢性炎症改变（C错）属于胃粘膜上皮炎症的病理表现；腺体缺失，间质纤维化（D错）为胃粘膜上皮萎缩的病理表现；中性粒细胞浸润（E错）代表炎症的活动性。